高血压健康教育对策的目标人群不包括
A. 高血压病患者及其家属
B. 高血压病高危人群
C. 一般健康人群
D. 社会公众
E. 社区领导者和决策者

正确答案：D。社会公众